确定职业性肿瘤病因的主要依据应来自
A. 病例分析
B. 细胞学检查
C. 病理学检查
D. 动物实验
E. 流行病学调查

正确答案：E。流行病学调查